既退虚热，又清湿热的药是
A. 青蒿
B. 白薇
C. 胡黄连
D. 地骨皮
E. 银柴胡

正确答案：C。胡黄连

解析：本题考查胡黄连的功效。既退虚热，又清湿热的药是胡黄连（C对）。胡黄连【功效】退虚热，除疳热，清湿热，解热毒。青蒿（A错）【功效】退虚热，凉血，解暑，截疟。白薇（B错）【功效】退虚热，凉血清热，利尿通淋，解毒疗疮。地骨皮（D错）【功效】退虚热，凉血，清肺降火，生津。银柴胡（E错）【功效】退虚热，清疳热。